在翼外肌的浅面有
A. 翼丛和上颌动脉
B. 下颌神经及其分支
C. 颞深前后神经和咬肌神经穿出
D. 上颌动脉穿入和颊神经穿出
E. 舌神经和下牙槽神经穿出

正确答案：A。翼丛和上颌动脉

解析：翼外肌的浅面有翼丛和上颌动脉。掌握“面侧深区及颌面部各间隙的境界”知识点。